可以致癌的生产性毒物是
A. 二异氰酸甲苯酯
B. 氯乙烯
C. TNT粉尘
D. 苯胺

正确答案：B。氯乙烯

解析：本题考查氯乙烯的致癌作用。调查发现，氯乙烯（B对ACD错）作业男工的肝癌发病率、死亡率明显高于对照组，发病年龄较对照组显著提前，且与作业工龄相关，并具有剂量-效应关系，说明了氯乙烯的致肝癌作用。有研究标明氯乙烯作业者造血系统、胃、呼吸系统、脑、淋巴组织等部位的肿瘤发病率相比于对照人群均有增高。